下列关于面部疖痈的治疗方法中，正确的是
A. 局部热敷
B. 苯酚、硝酸银烧灼
C. 高渗盐水纱布局部持续湿敷
D. 挤压、挑刺，以利于引流
E. 溃破后立即停止局部湿敷

正确答案：C。高渗盐水纱布局部持续湿敷

解析：痈的局部治疗宜用高渗盐水或含抗生素的盐水纱布局部持续湿敷，可促进早期痈的局限、软化和穿破。已溃破或切开引流后，局部仍应以高渗盐水纱布持续湿敷，可收良好的提脓效果，但已脓污的盐水纱布应及时更换，湿敷一般应持续到脓液消失、创面趋于平复为止。过早停止湿敷，可因脓道阻塞而使病情反复加重。掌握“面部疖痈”知识点。